下列有关肺泡表面活性物质生理作用的叙述，哪项错误
A. 降低肺泡表面张力
B. 稳定肺泡内压
C. 维持肺泡于适当的扩张状态
D. 维持肺的回缩力
E. 阻止血管内水分滤人肺泡

正确答案：D。维持肺的回缩力